下列不属于行政处罚的是
A. 警告
B. 行政拘留
C. 责令停产停业
D. 查封、扣押
E. 罚款

正确答案：D。查封、扣押

解析：卫生行政处罚，是指卫生行政执法主体依据卫生法律、法规、规章对相对人违反卫生行政法律规范、尚未构成犯罪的行为给予制裁的行政执法行为。包括：警告（A对），罚款（E对），没收非法财物，没收违法所得，责令停产停业（C对），拘留属于行政强制（B对），暂扣或吊销有关许可证等。查封、扣押（D错，为本题正确答案）属于《行政强制法》规定（P40）。